下列分子中，通常不属于药物毒性作用靶标的是
A. DNA
B. RNA
C. 受体
D. ATP
E. 酶

正确答案：D。ATP

解析：本题考查药物毒性作用靶标。不属于药物毒性作用靶标的是ATP（D错，为本题正确答案）。药物毒性作用的主要产生机制：药物直接与靶点分子作用产生毒性，有些药物能与内源性靶点分子（如受体（C对）、酶（E对）、DNA（A对）、RNA（B对）、大分子蛋白、脂质等）结合发挥作用，并导致靶点分子结构和（或）功能改变而导致毒性作用的产生。